视物旋转动荡，如在舟车之上，称为
A. 目昏
B. 目痒
C. 目眩
D. 雀目
E. 内障

正确答案：C。目眩

解析：患者目眩（C对），则自觉视物旋转动荡，如坐舟车，因气虚、血亏、阴精不足，目失所养引起者，多属虚证；因肝火上炎、肝阳化风及痰湿上蒙清窍所致者，多属实证，或本虚标实证。目昏（A错）是指视物昏暗，模糊不清的症状。如两目昏花、干涩、视物不清者，可由气虚、肝血不足、肾精亏耗，目失所养而致。目痒（B错）是指自觉眼睑、眦内或目珠疹痒的症状，轻者揉拭则止，重者极痒难忍。内障（E错），指主要发生于瞳神及眼内各组织的疾病。多因脏腑内损，气血两亏，目失濡养所致，尤以肝肾不足为常见。患者可感觉眼前蚊绳飞舞，黑花飘荡，视物昏蒙，夜盲，甚至暴盲等等。雀盲是指白昼视力正常，每至黄昏以后视力明显减退，视物不清的症状，亦称夜盲、雀目（D错）、鸡盲。